治疗血行瘀滞，多配合用补气、行气药，是由于
A. 气能生血
B. 气能行血
C. 气能摄血
D. 血能生气
E. 血能载气

正确答案：B。气能行血

解析：气能推动与调控血液在脉中稳定运行。血行瘀滞时，配伍行气药，气足则能推动血液的运行，气行则血行（B对）。气能生血（A错）理论指导临床在治疗血虚的病变时，以补气药配合补血药。气能摄血（C错）理论指导临床在治疗大出血的危重病人时，用大剂量补气药以摄血。血能养气（D错）导致临床上血虚的病人往往兼有气虚的表现。血能载气（E错）导致临床上出现气随血脱的病变。